肛瘘手术中为避免术后肛门失禁最需要明确的是
A. 肛瘘外口距肛门的距离
B. 肛瘘内口数目
C. 瘘管与肛门括约肌的关系
D. 瘘管切开的范围是否充分
E. 肛瘘外口数目

正确答案：C。瘘管与肛门括约肌的关系

解析：肛门括约肌因持续性地伸展、被动松弛，可发生肛门失禁。肛瘘手术的关键是明确瘘管行程和内口位置，尽量减少肛门括约肌的损伤，防止肛门失禁，同时避免瘘的复发。因此肛瘘手术中为避免术后肛门失禁最需要明确的是瘘管与肛门括约肌的关系（C对）。